女，8个月。因发热2天，抽搐2次，伴呕吐，吃奶量减少，喜哭，易怒就诊。母乳喂养。查体：精神差，前囟饱满，心肺腹无异常发现，肌张力增高，脑脊液检查：外观混浊，白细胞1000×10⁶/L，中性粒细胞为主，糖1mmol/L，氯化物107mmol/L，蛋白质2.0g/L。最可能的诊断是
A. 病毒性脑膜炎
B. 结核性脑膜炎
C. 隐球菌性脑膜炎
D. 化脓性脑膜炎
E. 中毒性脑病

正确答案：D。化脓性脑膜炎

解析：患儿，有发热、抽搐、呕吐、前囟饱满、肌张力增高的临床表现，并且脑脊液检查可见白细胞1000×10⁶/L（增高），中性粒细胞为主，糖1mmol/L（降低），氯化物107mmol/L（降低），蛋白质2.0g/L（明显增高），因此该患儿最可能诊断的是化脓性脑膜炎（D对）。病毒性脑膜炎（A错）、隐球菌性脑膜炎的糖降低，氯化物多数降低（C错），中毒性脑病（E错）的脑脊液检查氯化物和糖都正常（而该患儿降低）。结核性脑膜炎白细胞以淋巴细胞增高为主，而不是以中性粒细胞增高为主（B错）。